药用部位为干燥块根的药材有
A. 白及
B. 何首乌
C. 天冬
D. 麦冬
E. 太子参

正确答案：B、C、D、E。何首乌；天冬；麦冬；太子参

解析：本题考查的是根及根茎类中药的药用部位。药用部位为干燥块根的药材有何首乌（B对）、天冬（C对）、麦冬（D对）与太子参（E对）。何首乌：【来源】为蓼科植物何首乌的干燥块根。太子参：【来源】为石竹科植物孩儿参的干燥块根。天冬：【来源】为百合科植物天冬的干燥块根。麦冬：【来源】为百合科植物麦冬的干燥块根。白及（A错）：【来源】为兰科植物白及的干燥块茎。